具有阻断多巴胺D₂受体活性和抑制乙酰胆碱脂酶活性，且无致心律失常不良反应的促胃肠动力药物是
A. 多潘立酮
B. 西沙必利
C. 伊托必利
D. 莫沙必利
E. 甲氧氯普胺

正确答案：C。伊托必利

解析：本题考查促胃肠动力药。具有阻断多巴胺D₂受体活性和抑制乙酰胆碱脂酶活性，且无致心律失常不良反应的促胃肠动力药物是伊托必利（C对）。多潘立酮（A错）为较强的外周性多巴胺D₂受体阻断药。西沙必利（B错）为CYP3A4强效抑制剂，主要用于功能性消化不良。莫沙必利（D错）是强效、选择性5-HT₄受体激动药，能促进乙酰胆碱的释放，刺激胃肠道而发挥促动力作用。甲氧氯普胺（E错）为多巴胺D₂受体阻断药。